胰蛋白酶可激活的消化酶或酶原是
A. 胃蛋白酶原
B. 胰淀粉酶
C. 辅脂酶
D. 胰蛋白酶原
E. 糜蛋白酶原

正确答案：E。糜蛋白酶原